在面粉中强化哪种氨基酸可明显提高蛋白质的营养价值
A. 亮氨酸
B. 赖氨酸
C. 苏氨酸
D. 组氨酸
E. 精氨酸

正确答案：B。赖氨酸